关于气雾剂中抛射剂的说法，错误的是
A. 抛射剂有时可兼作药物的溶剂
B. 抛射剂有时可兼作药物的稀释剂
C. 抛射剂常温下蒸汽压小于大气压
D. 抛射剂是喷射药物的动力
E. 压缩惰性气体可作为抛射剂

正确答案：C。抛射剂常温下蒸汽压小于大气压

解析：本题考查的是抛射剂。抛射剂常温下蒸汽压大于大气压（C错，为本题正确答案）。气雾剂的抛射剂：为适宜的低沸点液化气体，常温下蒸气压大于1个大气压，当阀门打开时，抛射剂急剧气化产生压力，克服了液体分子间的引力，将药物分散成雾状微粒或泡沫状、干粉状喷出。因此，抛射剂是喷射药物的动力（D对），有时兼作药物的溶剂（A对）和稀释剂（B对）。根据气雾剂所需压力，可将两种成几种抛射剂以适宜比例混合使用。①氢氟烷烃类：氟氯烷烃类，又称氟利昂，曾为气雾剂常用的抛射剂，现已禁用。目前氢氟烷烃被认为是最合适的氟利昂代用品，不含氯，不破坏大气臭氧层。目前作为气雾剂抛射剂的主要有四氟乙烷（HFA-134a）、七氟丙烷（HFA-227ea）及二氟乙烷（HFA-152a）等。②二甲醚：为一种无色气体，沸点-24.9℃，室温下的饱和蒸气压约为0.5MPa，对极性和非极性药物有高度的溶解性，并易压缩、易液化或气化，与不燃性物质混合可用作腔道和黏膜气雾剂的抛射剂。但因其可燃性问题，至今尚未批准用于吸入气雾剂。③碳氢化合物：如丙烷、正丁烷、异丁烷，虽然稳定、毒性小、密度与沸点低，但易燃、易爆，不宜单独使用。常与其他抛射剂合用。④惰性气体（E对）：压缩惰性气体（N₂、CO₂等），性质稳定，不与药物发生反应，不燃烧。但液化后沸点较低，常温下蒸气压过高，对容器耐压性能要求高（需小钢球包装）。